在下列药物中，既可发汗解表，又可治疗血瘀经闭、痛经的药物是
A. 桂枝
B. 防风
C. 荆芥
D. 羌活
E. 麻黄

正确答案：A。桂枝

解析：桂枝既可发汗解肌，外散风寒，又可温通经脉，散寒止痛，治妇女寒凝血滞，月经不调，经闭痛经（A对）。防风（B错）既能祛风解表，又能胜湿止痛，故外感风寒、风湿、风热表证均可配伍使用。荆芥（C错）长于发表散风，对于外感表证，无论风寒、风热或寒热不明显者，均可使用。羌活（D错）有较强的解表散寒，祛风胜湿止痛之效，故外感风寒夹湿，恶寒发热，肌表无汗，肢体酸痛较重者尤为适宜。麻黄（E错）发汗力强，宜用于风寒外郁，腠理闭密无汗的外感风寒表实证。